患者，男，66岁，身高176cm，体重79kg，BMI25.5kg/m²，腰围88cm，高血压病史3年，规律服药，血压控制良好，有冠心病和糖尿病家族史。该患者目前的营养状况和应采取的措施是
A. 肥胖，首选控制饮食和增加运动
B. 超重，首选控制饮食和增加运动
C. 腹型肥胖，首选药物辅助减重
D. 超重，首选药物辅助减重
E. 体重正常，应控制体重，不可超过81kg

正确答案：B。超重，首选控制饮食和增加运动

解析：本题考查肥胖的标准。由题干知，该患者BMI25.5kg/m²，BMI24.0～27.9为超重，故该患者为超重，应首先控制饮食和增加运动（B对），不首选药物减重（D错）。体重指数（BMI）和腰围作为判断肥胖的指标。BMI=体重/（身高）²。中国成年人正常BMI（kg/m²）为18.5～23.9（E错），24.0～27.9为超重，≥28.0为肥胖（A错）；腰围≥90/85cm（男/女）可判定为腹型肥胖（C错）。